《药品生产许可证》许可事项变更不包括
A. 企业生产范围的变更
B. 企业法定代表人的变更
C. 企业生产地址的变更
D. 企业负责人的变更

正确答案：B、D。企业法定代表人的变更；企业负责人的变更

解析：本题考查药品生产许可证的管理。《药品生产许可证》许可事项变更不包括企业法定代表人的变更（B错，为本题正确答案）或企业负责人的变更（D错，为本题正确答案）。《药品生产监督管理办法》第二章生产许可第十五条：药品生产许可证载明事项分为许可事项和登记事项。许可事项是指生产地址（C对）和生产范围（A对）等。登记事项是指企业名称、住所（经营场所）、法定代表人、企业负责人、生产负责人、质量负责人、质量受权人等。